男，28岁，图书馆管理员，今整理图书期间出现突发咳嗽，气喘，呼吸困难，既往过敏性鼻炎病史，听诊双肺散在哮鸣音。什么辅助检查最有意义
A. 支气管舒张试验
B. 胸部X线片
C. 胸部高分辨CT
D. 超声心动图
E. 动脉血气分析

正确答案：A。支气管舒张试验

解析：支气管舒张试验结果为阳性，提示存在可逆性的气道阻塞（A对）。胸部X线片一般用于肺炎、气胸、肺结核等，不能确诊支气管哮喘（B错）。胸部高分辨CT用于支气管扩张的诊断检查（C错）。超声心动图主要检查先天性心脏病、心脏瓣膜病等（D错）。动脉血气分析主要用于判断患者呼吸功能是否存在异常；判断患者是否存在酸碱平衡失调等（E错）。